与城市空气SO₂污染危害有关的是
A. 温室效应
B. 光化学烟雾
C. 汞的甲基化
D. 酸雨
E. 水体富营养化

正确答案：D。酸雨

解析：本题考查酸雨。城市空气污染是指空气中悬浮的有害物质，如烟尘、二氧化硫、氮氧化物等，这些有害物质会对人体健康造成危害。酸雨是指大气中的酸性物质，如二氧化硫和氮氧化物，在降雨过程中，这些物质会被带入地表，形成酸性降雨，这种酸性降雨会对环境造成污染，从而影响人们的健康。因此，与城市空气污染危害有关的是酸雨（D对ABCE错）。